暴露于口腔中的复层鳞状上皮，可有角化或不全角化，上皮钉突多而长的上皮
A. 结合上皮
B. 龈沟上皮
C. 牙龈上皮
D. 缩余釉上皮
E. 龈谷上皮

正确答案：C。牙龈上皮

解析：牙龈上皮暴露于口腔的部分为复层鳞状上皮，表面有角化或者不全角化。上皮钉突多而长。偶见黑色素细胞。掌握“牙龈”知识点。